男，80岁。高血压病史30年，收缩压160mmHg，舒张压70mmHg。患者脉压异常的最可能原因
A. 动脉瓣关闭不全
B. 大动脉管壁硬化
C. 心功能不全
D. 甲状腺功能亢进
E. 肾功能不全

正确答案：B。大动脉管壁硬化

解析：患者老年男性，高血压病史30年，收缩压160mmHg（正常值＜140mmHg），舒张压70mmHg（正常值＜90mmHg），患者可诊断为单纯收缩期高血压，且伴脉压（收缩压和舒张压的差值，正常值为30～40mmHg）明显加大。这种情况通常由于年龄增长并伴有长期高血压引起的大动脉管壁硬化（B对），管壁弹性纤维减少而胶原纤维增多，最终导致血管可扩张性降低，大动脉的弹性储器作用减弱，对血压的缓冲作用减弱，因而收缩压增高而舒张压降低，结果使脉压明显增大（九版生理学P121）。动脉瓣关闭不全（P299）（A错）可出现收缩压增高，舒张压降低，脉压增宽，但多伴有心前区不适、头颈部强烈动脉搏动感等症状，常可听到相应瓣膜区的典型杂音。心功能不全（C错）时心脏射血功能多会下降，从而导致收缩压降低，而舒张压却无明显变化。甲状腺功能亢进（P681）（D错）可由于心脏收缩能力加强，外周血管代偿性扩张，导致收缩压增高，舒张压降低，脉压增大，但甲亢好发于年轻女性，且多伴有易激动、乏力、怕热、多汗、消瘦等典型症状。肾功能不全（E错）多伴全身水肿，且对脉压的影响不大。